不属肾病综合征诊断标准的是
A. 大量蛋白尿
B. 明显水肿
C. 低蛋白血症
D. 尿量减少
E. 高脂血症

正确答案：D。尿量减少

解析：肾病综合征的的诊断时大量蛋白尿（A对），尿蛋白（+++～++++），24小时尿蛋白定量≥50mg/kg；血浆白蛋白低于25g/L（C对）；血浆胆固醇高于5.7mmoL/L（E对）；不同程度的水肿（B对）。以上四项中以大量蛋白尿和低白蛋白血症为必要条件（D错，为本题正确答案）。